小儿结核性脑膜炎的早期临床表现是
A. 前囟饱满
B. 性格改变
C. 惊厥
D. 意识模糊
E. 脑膜刺激征

正确答案：B。性格改变

解析：典型结核性脑膜炎起病缓慢，分为三期，早期（前驱期）约1-2周，主要症状为小儿性格改变，如少言、懒动、易倦、烦躁、易怒等（B对）。中期（脑膜刺激期）会出现明显脑膜刺激症（E错）颅内压增高致剧烈头痛、喷射性呕吐、嗜睡或烦躁不安、惊厥等（C错）。幼婴则表现为前囟彭隆（A错），颅缝裂开。晚期（昏迷期）会出现由意识朦胧（D错），半昏迷继而转为昏迷。